某化学试剂厂的贮存罐突然泄漏，处理事故的工人有3人突然感觉头晕、气急、胸闷、咳嗽，痰呈粉红色、泡沫状。胸部X线透视：肺纹理增粗、紊乱，两肺散在大小不等的片状阴影，边缘模糊。考虑的气体中毒类型是
A. 氯气
B. 氰化氢
C. 硫化氢
D. 一氧化碳
E. 甲烷

正确答案：A。氯气